调（牙合）治疗应选择在
A. 牙周基础治疗开始前
B. 龈上洁治术之后
C. 龈下刮治术之后
D. 牙周组织炎症被控制之后
E. 牙周基础治疗的任何时间

正确答案：D。牙周组织炎症被控制之后

解析：本题考查调（牙合）治疗的时机。调（牙合）治疗是指通过多种手段达到建立起平衡的功能性咬合关系，有利于牙周组织的修复和健康。调（牙合）的时机应在牙周组织的炎症被控制后进行（D对）。在牙周基础治疗之前（A错）、龈上、龈下洁治术之后（BC错）及牙周基础治疗的任何时间（E错），牙周炎症还未消退，此时牙伸长或移位，会造成调（牙合）不准确。而且，若牙周炎症不控制，单纯调（牙合）也难以获得好的效果。